有关粉体的正确表述是
A. 粉体的休止角越大，其流动性越好
B. 粉体的真体积越大、其真密度越大
C. 粉体的接触角越大、其润湿性越差
D. 粉体的总空隙越太，其孔隙率越小
E. 粉体的临界相对湿度越大，其吸湿性越强

正确答案：C。粉体的接触角越大、其润湿性越差